下述各肌中，哪一块既能屈踝关节（跖屈）又能使足外翻
A. 胫骨前肌
B. 胫骨后肌
C. 趾短伸肌
D. 趾长伸肌
E. 腓骨长肌

正确答案：E。腓骨长肌

解析：胫骨前肌（A错）伸踝关节，使足内翻；胫骨后肌（B错）屈踝关节，使足内翻；趾短伸肌（C错）伸第2～5趾；趾长伸肌（D错）伸踝关节，伸第2～5趾；腓骨长肌（E对）既能屈踝关节（跖屈）又能使足外翻。